有患者血中尿酸含量＞80mg/L，经临床别嘌呤醇治疗后尿酸降为50mg/L，病人尿液中可能出现哪种化合物
A. 尿黑酸
B. 别嘌呤核苷酸
C. 牛磺酸
D. 多巴胺
E. 精胺、精脒

正确答案：B。别嘌呤核苷酸